某军区于2014年1~6月对20万名指战员进行高血压普查，共检出高血压患者200名。下列哪一项表示方法是正确的
A. 发病率为100/10万
B. 罹患率为100/10万
C. 时点患病率为100/10万
D. 续发率为100/10万
E. 期间患病率为100/10万

正确答案：E。期间患病率为100/10万